根据《药品不良反应报告和监测管理办法》，应报告新的和严重的不良反应的是
A. 首次进口5年以内的进口药品
B. 已受理注册申请的新药
C. 已过新药监测期的国产药品
D. 处于Ⅲ期临床试验的药物

正确答案：C。已过新药监测期的国产药品

解析：本题考查药品不良反应报告。根据《药品不良反应报告和监测管理办法》，应报告新的和严重的不良反应的是已过新药监测期的国产药品（C对）。《药品不良反应报告和监测管理办法》第三章报告与处置第二节个例药品不良反应第二十条：新药监测期内的国产药品应当报告该药品的所有不良反应；其他国产药品，报告新的和严重的不良反应。进口药品自首次获准进口之日起5年内（A错），报告该进口药品的所有不良反应；满5年的，报告新的和严重的不良反应。